不属于弱势（脆弱）人群的是
A. 老年人
B. 职业紧张人群
C. 妇女儿童
D. 残疾人
E. 低收入人群

正确答案：B。职业紧张人群